β₂受体激动剂平喘作用的特点是
A. 心血管系统的不良反应少
B. 可激动α受体
C. 剂量过大可引起手指震颤
D. 均能皮下注射
E. 口服无效

正确答案：A、C。心血管系统的不良反应少；剂量过大可引起手指震颤

解析：本题考查β₂受体激动剂类平喘药的特点。β₂受体激动剂平喘作用的特点是心血管系统的不良反应少（A对）、剂量过大可引起手指震颤（C对）。β₂受体激动剂对心脏β₁受体激动作用较弱，增强心率等心血管系统的不良反应少，但不宜长期、单一使用，当其过量时引起手指震颤等不良反应。β₂受体激动剂不能激动α受体（B错），一般口服（E错）或吸入，不皮下注射（D错）。